流行病学实验研究中所使用的单盲法是为了避免以下哪一种因素对判断结果的影响
A. 研究者主观因素对结果的影响
B. 被研究者主观因素对结果的影响
C. 研究者及被观察者双方主观因素对结果的影响
D. 资料分析者主观因素对结果的影响

正确答案：B。被研究者主观因素对结果的影响

解析：本题考查单盲的概念。单盲指研究对象不知道自己是实验组还是对照组，即排除了被研究者主观因素对结果的影响（B对ACD错）。